伤寒患者解除隔离的标志是
A. 体温下降至正常
B. 血嗜酸粒细胞恢复正常
C. 临床症状消失后粪便培养连续2次阴性
D. 临床症状消失后2周
E. 自发病之日起已隔离满2周

正确答案：C。临床症状消失后粪便培养连续2次阴性

解析：伤寒患者按消化道传染病隔离，症状消失后，每隔5～7日送检粪便培养，连续2次阴性可解除隔离（C对）。发热期患者须卧床休息，退热后1周左右可轻度活动。